被毒蛇咬伤后，应立即在距伤口几厘米处的近心端进行结扎
A. 2～3cm
B. 5～10cm
C. 12～15cm
D. 16～18cm
E. 20cm以上

正确答案：B。5～10cm

解析：被毒蛇咬伤后，就地立即在咬伤部位近心端5～10cm（B对）进行绑扎，绑扎紧度以能阻断淋巴液和静脉血液回流而不妨碍动脉血的供应为宜。